患者，男，68岁。打哈欠后突然下颌不能闭合，流涎，下颌中线偏向一侧。根据上述症状，该患者最可能的诊断是
A. 颞下颌关节复发性脱位
B. 颞下颌关节急性前脱位
C. 颞下颌关节急性后脱位
D. 颞下颌关节陈旧性脱位
E. 颞下颌关节侧方脱位

正确答案：B。颞下颌关节急性前脱位

解析：急性前脱位是临床最常见的颞下颌关节脱位。在正常情况下，大开口末，髁突和关节盘从关节窝向前滑动，止于关节结节下方或稍前方。咀嚼肌紊乱或关节结构紊乱的患者，当大开口时，翼外肌继续收缩将髁突过度地向前拉过关节结节；同时闭口肌群发生反射性挛缩，使髁突脱位于关节结节前上方，而不能自行复回原位。掌握“颞下颌关节脱位”知识点。